27岁初产妇，妊娠40周。阵发性腹痛10小时，宫缩10～15分钟1次，一次持续30秒，宫口开大2cm。此时的处理原则应是
A. 静脉滴注缩宫素
B. 静脉滴注麦角新碱
C. 肌内注射哌替啶（杜冷丁）
D. 人工破膜
E. 立即行剖宫产术

正确答案：C。肌内注射哌替啶（杜冷丁）

解析：该孕妇已阵痛10小时，宫口开大2cm（第一产程初产妇一般为11～12小时），宫缩一次持续时间30秒，10～15分钟1次，（第一产程，开始时宫缩持续30秒且弱，间歇期5～6分钟1次）综合该产妇的临床表现可判断该产妇属于第一产程潜伏期。由于宫缩间歇期长于正常间歇期，因此可诊断为子宫收缩节律性异常。由于该产妇已阵痛10小时且10～15分钟1次（产程一开始就出现宫缩乏力），同时无正常节律性、对称性和极性的临床表现，因此可判断为不协调性子宫收缩乏力（协调性宫缩乏力于产程早期宫缩正常，第一产程活跃期后期或第二产程宫缩减弱）。不协调性子宫收缩乏力的处理原则是调节子宫收缩，恢复节律性，首选药物为哌替啶（C对），使产妇充分休息，醒后不协调性宫缩多能恢复为协调性宫缩。静脉滴注缩宫素（A错）和人工破膜（D错）为协调性宫缩乏力的处理方法（P189）。静脉滴注麦角新碱（B错）主要用于治疗产后子宫出血、产后子宫复旧不全、月经过多等。产妇尚处于第一产程且未有行剖宫产术的指证，故不立即行剖宫产术（E错）。